下列关于调查设计的叙述，正确的是
A. 明确调查目的是调查研究最核心的问题
B. 采用抽样调查还是普查是由该地区的经济水平决定的
C. 调查设计出现缺陷时，都可以通过相应的统计分析方法弥补
D. 一旦制定了调查研究计划，在实际操作过程中，就不能改变
E. 调查的质量控制主要在调查问卷设计阶段

正确答案：A。明确调查目的是调查研究最核心的问题